镇静催眠药
A. 氟烷
B. 盐酸氯胺酮
C. 盐酸普鲁卡因
D. 地西泮
E. 卡马西平

正确答案：D。地西泮